患儿男，2岁。脾胃虚弱，症见消化不良、不思乳食、腹胀便溏。宜选用的中成药是
A. 薯蓣丸
B. 肥儿丸
C. 小儿化食丸
D. 启脾丸
E. 一捻金

正确答案：D。启脾丸

解析：本题考查启脾丸的主治。宜选用的中成药是启脾丸（D对）。启脾丸【主治】脾胃虚弱，消化不良，腹胀便溏。薯蓣丸（A错）【主治】气血两虚，脾肺不足所致的虚劳、胃脘痛、痹病、闭经、月经不调。肥儿丸（B错）【主治】小儿消化不良，虫积腹痛，面黄肌瘦，食少腹胀泄泻。小儿化食丸（C错）【主治】食滞化热所致的积滞，症见厌食、烦躁、恶心呕吐、口渴、脘腹胀满、大便干燥。一捻金（E错）【主治】脾胃不和、痰食阻滞所致的积滞，症见停食停乳、腹胀便秘、痰盛喘咳。